患者72岁，下前牙自发性阵痛就诊。查下前牙磨损明显，左右下1冷测（++），叩（-），X线示牙周情况正常。牙髓的感染途径为
A. 牙周感染
B. 血源性感染
C. 龋病
D. 牙隐裂
E. 磨损

正确答案：E。磨损

解析：本题考查磨损的临床表现。患牙自发性阵痛，冷（++），叩（-），说明患牙患有牙髓炎。患牙磨损明显，细菌可通过暴露的牙本质小管进入牙髓引起牙髓感染，该牙髓的感染途径是牙齿磨损（E对）。X线示牙周情况正常，表明牙髓炎不是由牙周感染引起的（A错）。未述该患者患有引起血源性感染的疾病（B错），如菌血症或败血症。检查时未发现患牙有龋病或牙隐裂，可排除（CD错）。